除另有规定外，不含毒性药的中药酊剂100ml应相当于原饮片
A. 1g
B. 2g～5g
C. 5g～10g
D. 10g
E. 20g

正确答案：E。20g

解析：本题考查的是酊剂的质量要求。除另有规定外，不含毒性药的中药酊剂100ml应相当于原饮片20g（E对）。酊剂：系指原料药物用规定浓度的乙醇提取或溶解而制成的澄清液体制剂，也可用流浸膏稀释制成。除另有规定外，普通中药酊剂每100ml相当于原饮片20g。含有毒性药品的中药酊剂，每100ml应相当于原饮片10g（D错）。除另有规定外，酊剂应遮光，密封，置阴凉处贮存。按照《中国药典》规定的方法检查，酊剂的甲醇量、乙醇量、装量及微生物限度等均应符合有关规定。流浸膏剂：系指饮片用适宜的溶剂提取，蒸去部分或全部溶剂，调整至规定浓度而制成的制剂。按照《中国药典》规定的方法检查，流浸膏剂的装量、微生物限度应符合规定。含有乙醇的流浸膏剂的乙醇量、甲醇量应符合规定。除另有规定外，流浸膏剂要求每1ml相当于饮片1g（A错）。浸膏剂分为稠膏和干膏两种，每1g相当于饮片2～5g（B错）。相当于饮片5g～10g（C错）的剂型，2022年考试指南未明确说明。